确定肺结核是否为传染源的最主要依据是
A. 血沉检查
B. X线检查
C. 痰结核菌检查
D. 结核菌素试验
E. 血结核抗体检查

正确答案：C。痰结核菌检查

解析：痰结核菌检查（C对）于涂片中找到抗酸杆菌，说明患者正处于排菌状态，具有传染性，是结核病在人群中的主要传染源。血沉（A错）只能提示肺结核是否处于活动期，并不提示是否具有传染性。X线检查（B错）有助于肺结核的诊断，不能明确是否为排菌状态。结核菌素试验（D错）和血结核抗体检查（E错）只能用来鉴别患者是否曾受结核杆菌感染，并不能确定是否为传染源。